属于牙周病三级预防的是
A. 口腔健康教育和指导
B. 口腔卫生宣教
C. 龈上洁治术
D. X线检查
E. 牙周手术

正确答案：E。牙周手术

解析：本题考查牙周病的分级预防。属于牙周病三级预防的是牙周手术（E对）。牙周病的分级预防：1.一级预防又称初级预防，是指在在牙周组织受到损害之前防止致病因索的侵袭，或致病因素已侵袭到牙周组织，但尚未引起牙周病损之前立即将其去除。一级预防旨在减少人群中牙周病新病例的发生，主要是对大众进行口腔健康教育和指导（A错），最终达到清除菌斑和其他有害刺激因子的目的，帮助人们建立良好口腔卫生习惯，掌握正确刷牙方法，同时提高宿主的抗病能力。牙周病一级预防就是把口腔卫生知识传播给大众，使他们自觉地执行各种家庭口腔卫生措施，并定期进行口腔保健，维护口腔健康。2.二级预防旨在早期发现、早期诊断、早期治疗，减轻已发生的牙周病的严重程度，控制其发展。对局限于牙龈的病变，及时采取专业性洁治，去除菌斑和牙石，控制其进一步发展。采用X线检查法（D错）定期追踪观察牙槽骨情况，根据情况采取适当的治疗，如龈上洁治术（C错）、龈下刮治术及根面平整等。去除促进牙周病发展的刺激因素，如去除不良修复体、治疗食物嵌塞、充填邻面龋损等，牙周组织的健康状况可得到显著改善。二级预防的效果是在一级预防基础上取得的，其长期效果与患者是否能长期坚持各种预防措施有关。3.三级预防旨在用各种药物和牙周手术方法最大限度地治愈牙周组织病损，防止功能障碍，以义齿修复失牙，重建功能，并通过随访、精神疗法和口腔健康维护，维持其疗效，预防复发。同时，还应治疗相关的全身性疾病，如糖尿病、血液病、营养缺乏症，增强牙周组织抵抗力。